控制中枢性尿崩症的药物首选
A. 氯磺丙脲
B. 垂体后叶素
C. 鞣酸加压素
D. 去氨加压素
E. 氢氯噻嗪

正确答案：D。去氨加压素

解析：中枢性尿崩症患者，抗利尿激素（AVP，精氨酸加压素）的合成、转运、储存及释放受到影响，导致其血中AVP浓度下降。由于其尿量增多的原因为精氨酸加压素缺乏，因此为控制多尿应补充精氨酸加压素或其类似物。去氨加压素（D对）为精氨酸加压素类似物，因其抗利尿作用强，而无加压作用，不良反应少，为目前治疗尿崩症的首选药物。非激素类抗利尿药物如氯磺丙脲（A错）（P675）、卡马西平等，可刺激AVP释放并增强AVP对肾小管的作用，但抗利尿作用不及去氨加压素，临床上不作为首选药物。垂体后叶素（P675）（B错）作用维持时间短，需多次注射，长期应用不便，主要用于脑损伤或手术时出现的尿崩症。油剂鞣酸加压素注射液（P675）（C错）注射后维持时间较长，可减少频繁注射的麻烦，但是长期应用两年左右会因产生抗体而减效，注射过量会引起水中毒。氢氯噻嗪（P675）（E错）为肾性尿崩症的主要治疗药物，也可用于中枢性尿崩症，但不如去氨加压素效果好。